关于脑衰弱综合征，错误的叙述是
A. 核心症状是易兴奋和易疲劳
B. 睡眠障碍是其常见症状之一
C. 可继发于许多躯体疾病
D. 可见于精神分裂症
E. 对于神经衰弱具有诊断特异性

正确答案：E。对于神经衰弱具有诊断特异性

解析：脑衰弱综合征是一个非特异性的综合征，可出现在许多精神疾病、躯体疾病和神经系统疾病，作为这些疾病的伴随症状之一（C对），故对神经衰弱不具有诊断特异性（E错，为本题正确答案）。脑衰弱综合征以精神易兴奋、易疲劳（A对）为核心症状。